治疗弥漫性大B细胞淋巴瘤首选的方案是
A. M2方案
B. ESHAP方案
C. ABVD方案
D. CHOP方案
E. VLDP方案

正确答案：D。CHOP方案

解析：弥漫性大B细胞淋巴瘤属于侵袭性非霍奇金淋巴瘤，首选CHOP方案（D对）。ABVD方案（P585）（C错）是霍奇金淋巴瘤的首选化疗方案；MOPP方案（P585）（A错）是ABVD方案出现之前霍奇金淋巴瘤首选化疗方案；ESHAP方案（P590）（B错）是侵袭性非霍奇金淋巴瘤的化疗方案，但不是首选；VLDP方案（P575）（E错）为急性淋巴细胞白血病常用的诱导缓解方案。